暗适应时间延长是由于缺乏
A. 维生素C
B. 维生素B₁
C. 维生素PP
D. 维生素E
E. 维生素A

正确答案：E。维生素A